单纯性睾丸鞘膜积液最可靠的诊断依据是
A. 阴囊肿大
B. 阴嚢肿块表面光滑
C. 阴囊肿块有波动感
D. 透光试验阳性
E. 右侧阴囊无睾丸

正确答案：D。透光试验阳性

解析：睾丸鞘膜积液指睾丸鞘膜囊内积聚的液体增多，从而形成囊肿。单纯性睾丸鞘膜积液最可靠的诊断依据是透光试验阳性（D对），即在暗室内用黑色纸筒罩于阴囊，手电筒由阴囊肿物下方向上照射时，积液有透光性。阴囊肿大（A错）可见于睾丸肿瘤、腹股沟斜疝、睾丸炎等；阴囊肿块表面光滑（B错）可能为腹股沟斜疝；阴囊肿块有波动感（C错）可见于血性、脓性或乳糜性积液；阴囊无睾丸（E错）也可见于隐睾，以上表现均不能确诊睾丸鞘膜积液。